迷走神经不支配
A. 小肠
B. 胃
C. 心
D. 乙状结肠
E. 喉返神经

正确答案：D。乙状结肠

解析：迷走神经含有四种纤维成分：①一般内脏运动纤维，控制颈部、胸腔脏器和腹腔大部分脏器以及这些器官的平滑肌、心肌和腺体的活动（CE对）。②一般内脏感觉纤维，控制内脏的感觉。③特殊内脏运动纤维，支配软腮和咽喉肌。④一般躯体感觉纤维，周围突分布于硬脑膜、耳郭和外耳道。迷走神经在腹腔中分成许多小支分布于自胃至横结肠的消化管（A对D错，为本题正确选项）及肝、胰、脾、肾等实质性脏器。